体内NH₃的主要来源是
A. 肠道吸收
B. 肾脏产氨
C. 氨基酸脱氨基
D. 胺分解
E. 碱基分解

正确答案：C。氨基酸脱氨基